无需在肝脏代谢，严重肝功能不全者宜选用的中效糖皮质激素是
A. 地塞米松
B. 可的松
C. 泼尼松
D. 泼尼松龙
E. 氢化可的松

正确答案：D。泼尼松龙

解析：本题考查泼尼松龙。无需在肝脏代谢，严重肝功能不全者宜选用的中效糖皮质激素是泼尼松龙（D对）。泼尼松龙为中效糖皮质激素，无需在肝脏代谢，适用于严重肝功能不全者。地塞米松（A错）为长效糖皮质激素。可的松（B错）和氢化可的松（E错）均为短效糖皮质激素。泼尼松（C错）为前药，需在肝内转化为泼尼松龙而生效，故严重肝功能不全者宜选择泼尼松龙。